牙萌出后，牙根继续发育至牙根完全形成大约需
A. 半年以内
B. 1年
C. 1～2年
D. 2～3年
E. 5年以上

正确答案：D。2～3年

解析：本题考查牙的发育过程。恒牙虽已牙萌出，但在形态、结构上尚未完全形成和成熟，此种恒牙称年轻恒牙。年轻恒牙一般在牙根形成2/3左右时开始萌出，萌出后牙根继续发育，于萌出后2～3年（D对）牙根才达到应有的长度。半年以内（A错）、1年（B错）、1～2年（C错）萌出时间较短，牙根尚未发育至牙根完全形成。5年以上（E错）牙根已经发育完成。